中央型肺癌伴纵膈、肺门多发淋巴结肿大最常见于
A. 鳞癌
B. 大细胞癌
C. 小细胞癌
D. 腺癌
E. 类癌

正确答案：C。小细胞癌

解析：中央型肺癌是发生在段及以上支气管的肺癌，以鳞状上皮细胞癌和小细胞肺癌较多见，鳞状上皮细胞癌（A错）倾向于管腔内生长，常早期引起支气管狭窄，导致肺不张或阻塞性肺炎，癌组织易发生坏死和形成空洞，其生长较慢，转移较晚。小细胞肺癌（C对）易于侵犯血管和早期转移到肺门和纵膈淋巴结，其生长快，远处转移早。大细胞癌（B错）腺癌（D错）多见于周围型肺癌。类癌（E错）多见于消化道癌症。